对血小板聚集及凝血机制无影响的药品是
A. 罗非昔布
B. 对乙酰氨基酚
C. 吲哚美辛
D. 阿司匹林
E. 美洛昔康

正确答案：B。对乙酰氨基酚

解析：本题考查对乙酰氨基酚。对乙酰氨基酚（B对）主要用于解热镇痛，几乎没有抗炎作用，对血小板及凝血机制几乎无影响。